下列有关喹诺酮抗菌药构效关系的描述错误的是
A. 吡啶酮酸环是抗菌作用必须的基本药效基团
B. 3位COOH和4位C=O为抗菌活性不可缺少的部分
C. 8位与1位以氧烷基成环，使活性下降
D. 6位引入氟原子可使抗菌活性增大
E. 7位引入五元环或六元杂环可使抗菌活性增大

正确答案：C。8位与1位以氧烷基成环，使活性下降

解析：本题考查喹诺酮类抗菌药。将喹诺酮1位和8位成环得到左氧氟沙星，活性增强（C错，为本题正确答案）。吡啶酮酸环是抗菌作用必须的基本药效基团（A对）。3位羧基和4位羰基为关键药效基团，是抗菌活性不可缺少的部分（B对）。6位引入氟原子可使抗菌活性增大（D对）。7位引入五元环或六元杂环，抗菌活性增大（E对）。